女，29岁，半小时前从高处跌落，右下肢疼痛，活动受限。查体：神志清楚，右侧大腿、小腿压痛（+），畸形，异常活动。若患者生命征平稳，现场急救首选的处理是
A. 切开复位
B. 皮牵引
C. 临时固定
D. 闭合复位
E. 镇静止痛

正确答案：C。临时固定

解析：患者外伤后大腿和小腿畸形、异常活动（骨折特有体征，包括畸形、异常活动、骨擦音或骨擦感），可诊断为右下肢骨折（凡具有骨折特有体征之一者，均可诊断为骨折）。骨折急救包括抢救休克、包扎伤口、妥善固定、迅速转运。患者生命体征平稳，没有出血及开放性损伤，故当前首选的急救处理是临时固定（C对）。临时固定的目的是避免骨折端在搬运过程中对周围重要组织如血管神经的损伤，也可减少骨折端的活动，减轻病人的痛苦，同时便于运送。切开复位（A错）、皮牵引（B错）、闭合复位（D错）、镇静止痛（E错）均为医院内救治的内容。